不会影响全冠就位的情况是
A. 预备体有倒凹
B. 全冠边缘短
C. 铸造收缩
D. 蜡型变形
E. 邻接紧

正确答案：B。全冠边缘短

解析：全冠边缘短，不会造成就位困难，但是影响美观，易形成继发龋。掌握“修复体试戴、磨光与粘固”知识点。